下列各项，不属木香主治病证的是
A. 三焦气滞
B. 肺气阻滞
C. 肝胆气郁
D. 脾胃气滞
E. 大肠气滞

正确答案：B。肺气阻滞

解析：木香辛行苦泄温通，芳香气烈，能通理三焦，尤善行脾胃之气滞；善行大肠之滞气；走三焦和胆经，能疏理肝胆和三焦之气机（B错，为本题正确答案）。